小范围短时期内的发病率
A. 发病率
B. 死亡率
C. 罹患率
D. 病死率
E. 患病率

正确答案：C。罹患率